患者妊娠26周前出现少量阴道流血，无妊娠物排出，随后出现阵发性下腹痛。妇科检查：宫口未开，胎膜未破，子宫大小与停经周数相符。考虑诊断为
A. 先兆流产
B. 难免流产
C. 不全流产
D. 完全流产
E. 稽留流产

正确答案：A。先兆流产

解析：本题考查自然流产。患者妊娠26周前出现少量阴道流血，无妊娠物排出，随后出现阵发性下腹痛。妇科检查：宫口未开，胎膜未破，子宫大小与停经周数相符。考虑诊断为先兆流产（A对）。按自然流产发展的不同阶段，分为以下临床类型。1.先兆流产：指妊娠28周前先出现少量阴道流血，常为暗红色或血性白带，无妊娠物排出，随后出现阵发性下腹痛或腰背痛。妇科检查宫颈口未开，胎膜未破，子宫大小与停经周数相符。经休息及治疗后症状消失，可继续妊娠；若阴道流血量增多或下腹痛加剧，可发展为难免流产。2.难免流产（B错）：指流产不可避免。在先兆流产基础上，阴道流血量增多，阵发性下腹痛加剧，或出现阴道流液（胎膜破裂）。妇科检查宫颈口已扩张，有时可见胚胎组织或羊膜囊堵塞于宫颈口内，子宫大小与停经周数基本相符或略小。3.不全流产（C错）：难免流产继续发展，部分妊娠物排出宫腔，还有部分残留于宫腔内或嵌顿于宫颈口处，或胎儿排出后胎盘滞留宫腔或嵌顿于宫颈口，影响子宫收缩，导致出血，甚至发生休克。妇科检查见宫颈口已扩张，宫颈口有妊娠物堵塞及持续性血液流出，子宫小于停经周数。4.完全流产（D错）：指妊娠物已全部排出，阴道流血逐渐停止，腹痛逐渐消失。妇科检查宫颈口已关闭，子宫接近正常大小。流产有3种特殊情况：1.稽留流产（E错）：又称过期流产。指胚胎或胎儿已死亡滞留宫腔内未能及时自然排出者。表现为早孕反应消失，有先兆流产症状或无任何症状，子宫不再增大反而缩小。若已到中期妊娠，孕妇腹部不见增大，胎动消失。妇科检查宫颈口未开，子宫较停经周数小，质地不软，未闻及胎心。2.复发性流产：指与同一性伴侣连续发生3次及3次以上的自然流产。3.流产合并感染。